内脏痛的特点
A. 刺痛
B. 快痛
C. 定位不精确
D. 必有牵涉痛
E. 对牵拉不敏感

正确答案：C。定位不精确